在手外侧，第1掌骨桡侧中点赤白肉际处的穴位是
A. 大陵
B. 太渊
C. 合谷
D. 鱼际
E. 后溪

正确答案：D。鱼际

解析：鱼际定位在手外侧，第1掌骨桡侧中点赤白肉际处（D对）。大陵定位在腕前区，腕掌侧远端横纹中，掌长肌腱与桡侧腕屈肌腱之间（A错）。太渊定位在腕前区，桡骨茎突与舟状骨之间，拇长展肌腱尺侧凹陷中（B错）。合谷定位在手背，第2掌骨桡侧的中点处（C错）。后溪定位在手内侧，第5掌指关节尺侧近端赤白肉际凹陷中（E错）。